具有良性组织学表现、但发生了转移的成釉细胞瘤称为
A. 恶性成釉细胞瘤
B. 成釉细胞瘤-滤泡型
C. 成釉细胞瘤-颗粒细胞型
D. 成釉细胞瘤-基底细胞型
E. 角化成釉细胞瘤

正确答案：A。恶性成釉细胞瘤

解析：恶性上皮性牙源肿瘤中还有一种为转移性（恶性）成釉细胞瘤是指具有良性组织学表现、但发生了转移的成釉细胞瘤。掌握“成釉细胞癌”知识点。